急性上呼吸道细菌感染最常见的病原菌是
A. 溶血性链球菌
B. 流感嗜血杆菌
C. 肺炎链球菌
D. 葡萄球菌
E. 铜绿假单胞菌

正确答案：A。溶血性链球菌

解析：急性上呼吸道感染简称上感，为外鼻孔至环状软骨下缘包括鼻腔、咽或喉部急性炎症的总称，主要是病毒感染，少数是细菌。其中最常见的细菌为溶血性链球菌（A对），其次是流感嗜血杆菌（B错）、肺炎链球菌（C错）和葡萄球菌（D错）等，偶见铜绿假单胞菌（E错）等革兰阴性菌杆菌。